五味理论认为，能收敛邪气，凡邪未尽之证均当慎用的味是
A. 辛
B. 甘
C. 酸
D. 苦
E. 咸

正确答案：C。酸

解析：本题考查的是五味对人体的效果。五味理论认为，能收敛邪气，凡邪未尽之证均当慎用的味是酸（C对）。五味对人体的效果：（1）辛（A错）：辛味药大多能耗气伤阴，气虚阴亏者慎用。（2）甘（B错）：甘味药大多能腻膈碍胃，令人中满，凡湿阻、食积、中满气滞者慎用。（3）酸：酸味药大多能收敛邪气，凡邪未尽之证均当慎用。（4）苦（D错）：苦味药大多能伤津、伐胃，津液大伤及脾胃虚弱者不宜大量用。（5）咸（E错）：食盐类咸味药不宜多食，高血压动脉硬化者尤当如此。（6）涩：涩味药大多能敛邪，邪气未尽者慎用。（7）淡：淡味药过用，亦能伤津液，阴虚津亏者慎用。此外，还有芳香味。芳香味与辛味一样，亦能耗气伤津，气虚津亏者慎用。